咽为前后略扁的漏斗状肌性管道，是消化道与呼吸道的共同通道，以软腭与会厌上缘为界，分为鼻咽、口咽和喉咽。咽的交通关系，错误的是
A. 口咽部经咽峡通口腔
B. 喉咽部经喉口通喉腔
C. 鼻咽部经鼻后孔通鼻腔
D. 经咽鼓管咽口通内耳
E. 向下通食管

正确答案：D。经咽鼓管咽口通内耳

解析：口咽向前经咽峡通口腔(A对)，喉咽经喉口通喉腔(B对)，鼻咽向前经鼻后孔通鼻腔(C对)，经咽鼓管咽口通中耳(D错，为本题正确答案)，咽向下通食管(E对)。